目前最常用的智力高低表示法是
A. 比率智商
B. 离差智商
C. 百分位数
D. 智力年龄
E. 项目数

正确答案：B。离差智商

解析：智商有两种计算方式：一种是“年龄智商”，也称为“比率智商”，它是以一个人的年龄为参照标准来对智力进行衡量。由于一个人的智力在成年时不会随着实际年龄持续增长，因此年龄智商在实际应用中会受到很大限制，它不适合用于成年人。后来韦克斯勒在编制智力测验时发展了“离差智商”来取代“年龄智商”。故离差智商是目前比较常用的智力高低表示方法。掌握“常用的心理测验及临床评定测量表”知识点。